中药鉴定的法定依据有
A. 《中国药典》
B. 《部颁药品标准》
C. 企业药品标准
D. 《中药志》
E. 《中药大辞典》

正确答案：A、B。《中国药典》；《部颁药品标准》